某校六年级（12岁年龄组）300名学生中恒牙有龋、失、补的人数为180人，未治龋齿数为328个，因龋失牙数为3个，因龋充填牙数为69个。该年级学生的龋均为
A. 1.2
B. 1.3
C. 1.4
D. 1.5
E. 1.6

正确答案：B。1.3

解析：本题考查龋均的计算。某校六年级（12岁年龄组）300名学生中恒牙有龋、失、补的人数为180人，未治龋齿数为328个，因龋失牙数为3个，因龋充填牙数为69个。该年级学生的龋均为1.3（B对）。龋均为每个患者所患龋齿的平均数，即（328+3+69）÷300=1.3。